在紫外分光光度法中，供试品溶液的浓度应使吸收度的范围在
A. 0.1～0.3
B. 0.3～0.5
C. 0.3～0.7
D. 0.5～0.9
E. 0.1～0.9

正确答案：C。0.3～0.7